属于有丝分裂抑制剂的抗肿瘤药是
A. 伊马替尼
B. 他莫昔芬
C. 氨鲁米特
D. 氟他胺
E. 紫杉醇

正确答案：E。紫杉醇

解析：本题考查有丝分裂抑制剂的抗肿瘤药。紫杉醇（E对）的抗肿瘤作用机制是通过诱导和促使微管蛋白聚合成微管，同时抑制所形成微管的解聚，从而抑制了细胞分裂和增殖；伊马替尼（A错）为酪氨酸激酶抑制剂；他莫昔芬（B错）为雌二醇竞争性拮抗剂；氨鲁米特（C错）用于皮质醇增多症,抑制肾上腺皮质功能的；氟他胺（D错）为非甾体类抗雄激素药物。